骨性愈合X线征象出现于
A. 1～3个月
B. 2～4个月
C. 3～6个月
D. 4～8个月
E. 12个月

正确答案：C。3～6个月

解析：本题考查骨折愈合的影像学表现。骨性愈合X线征象出现于3～6个月（C对）。骨折的愈合：颌面骨骨折1～2个月后，临床上已有明显愈合；一般在3～6个月后可见骨性愈合X线征象。